对半衰期短的药物，为了减少血药浓度波动，可采取的方法是
A. 延长给药间隔
B. 缩短给药间隔的同时减少单次给药剂量
C. 增加给药剂量
D. 减少给药剂量
E. 增加给药剂量的同时延长给药间隔

正确答案：E。增加给药剂量的同时延长给药间隔

解析：本题考查半衰期小的药物的给药方案。增加给药剂量的同时延长给药间隔（E对）是对半衰期短的药物，为了减少血药浓度波动可采取的方法。增加给药剂量的同时延长给药间隔会使血药浓度趋于稳定，减少波动；缩短给药间隔的同时减少单次给药剂量（B错）虽然能减少血药浓度波动，但是临床不适用；单纯的增加（C错）、减少给药剂量（D错）或延长给药间隔（A错），血药浓度都会有很大的波动。